鸡内金除运脾消食以外，又能
A. 降气化痰
B. 活血理气
C. 固精止遗
D. 疏肝回乳
E. 破气消积

正确答案：C。固精止遗

解析：本题考查鸡内金的功效。鸡内金除运脾消食以外，又能固精止遗（C对）。鸡内金【功效】运脾消食，固精止遗，化坚消石。莱菔子【功效】消食除胀，降气化痰（A错）。川芎【功效】活血行气（B错），祛风止痛。麦芽【功效】消食和中，回乳，疏肝（D错）。枳实【功效】破气消积（E错），化痰除痞。